成人丙氨酸氨基转移酶正常值的参考范围是
A. ＜40U/L
B. ≤50U/L
C. ≤30U/L
D. <500U/L
E. 40～150U/L

正确答案：A。＜40U/L

解析：本题考查的是血清丙氨酸氨基转移酶的参考范围。成人丙氨酸氨基转移酶正常值的参考范围是＜40U/L（A对）。血清丙氨酸氨基转移酶（ALT）：ALT是一组催化氨基酸与α-酮酸间氨基转移反应的酶类，主要存在于肝、肾、心肌、骨骼肌、胰腺、脾、肺、红细胞等组织细胞中，同时也存在于正常体液如血浆、胆汁、脑脊液、唾液中。当富含ALT的组织细胞受损时，ALT从细胞释放增加，进入血液后导致ALT活力上升。参考值为：速率法：成人5～40U/L。